5岁女孩，身高82cm，洗澡时发现乳房增大，无其他异常表现，否认特殊饮食及服药史，骨龄与实际年龄相当，腹腔B超检查正常，最可能的诊断是
A. 乳房肿物
B. 中枢性性早熟
C. 单纯乳房早发育
D. 正常女童
E. 外源性雌激素影响

正确答案：C。单纯乳房早发育

解析：单纯性乳房早发育仅仅表现为乳房大提前发育，无其他病理表现及第二性征的发育（C对）。乳腺肿块绝大多数都是良性病变，如乳腺腺病、乳腺纤维腺瘤、乳腺囊肿、导管内乳头状瘤、乳腺导管扩张症和乳腺结核等（A错）。中枢性性早熟临床表现中第二性征发育的顺序与正常发育是一致的，但是明显提前并且加速，由于过早发育引起患儿近期蹄长，骨骼生长加速，骨龄提前，骨骺可提前融合，影响终身高（B错）。一般女孩乳房的发育时间大概在9到10岁，10到11岁时乳腺开始增生，形成乳核，摸上去有个小的结节或者硬块，压之疼痛。十二三岁时，随着卵巢逐步成熟，在卵巢激素，垂体激素的共同作用之下，乳房开始发育（D错）。外源性雌激素影响可能导致女孩出现同性性早熟（E错）。